服用华法林期间应进行监测的指标是
A. ALT
B. APTT
C. INR
D. RBC
E. WBC

正确答案：C。INR

解析：本题考查服用华法林期间应进行监测的指标。INR（C对）测定主要用于维生素K拮抗剂（如华法林）抗凝效果的检测，INR控制在2.0～3.0时，可有效预防脑卒中事件。谷丙转氨酶（ALT）（A错）是诊断病毒性肝炎、中毒性肝炎的重要指标。使用肝素静脉滴注期间需要监测活化部分凝血活酶时间（APTT）（B错）。红细胞计数（RBC）（D错）是指单位体积血液中所含红细胞数目。白细胞计数（WBC）（E错）是指单位体积血液中所含白细胞数目。